一氧化碳中毒现场急救首先采取的是
A. 吸氧
B. 建立静脉通道
C. 就地心肺复苏
D. 清洗皮肤
E. 撤离现场

正确答案：E。撤离现场

解析：—氧化碳中毒现场急救首先应采取的是撤离现场（E对），终止CO继续吸入，之后再采取吸氧（A错），就地心肺复苏（C错）亦不可取。建立静脉通道（B错）非CO中毒的必要急救措施。CO中毒途径为经呼吸道吸入，并非经皮肤吸收，故清洗皮肤（D错）于治疗无效。